诊断脾破裂最有价值的是
A. 左上腹部有外伤史
B. 有休克表现
C. 有进行性贫血
D. 腹部有压痛和反跳痛
E. 腹腔穿刺抽出不凝血液

正确答案：E。腹腔穿刺抽出不凝血液

解析：脾脏为腹腔实质性器官，破裂后出血量往往很大。作诊断性腹腔穿刺抽出不凝血（E对）即可确诊，阳性率可达90%以上。休克（B错）、进行性贫血（C错）为脾破裂晚期的表现，早期诊断价值有限。左上腹外伤史（A错）对于诊断脾破裂有辅助诊断的价值，但其不具有特异性。血液对腹膜仅有轻微刺激性，脾破裂后，腹部压痛和反跳痛（D错）不甚明显。